下列哪项不是城市生态系统的特征
A. 人为性
B. 复杂性
C. 不完整性
D. 丰富性
E. 脆弱性

正确答案：D。丰富性

解析：本题考查城市生态系统的特征。城市生态系统是在城市区域内，由生物群落及其生存环境共同组成的动态系统。城市生态系统具有自然生态系统的某些共性，同时又具有人为性（A对）、不完整性（C对）、复杂性（B对）和脆弱性（E对）等独特的个性。丰富性（D错，为本题正确答案）不属于城市生态系统的特征。